女，18岁。近几个月来常因琐事与父母发生激烈争吵，闷闷不乐，被诊断为抑郁症而入院治疗。两周后，其父母去探视，患者起初表现出既想见又不想见的矛盾心理，但最终还是决定拒绝见其父母。医生根据病情同意了患者的决定。该患者起初的心理状态属于
A. 双重趋避冲突
B. 趋避冲突
C. 回避冲突
D. 双避冲突
E. 双趋冲突

正确答案：B。趋避冲突

解析：动机冲突有四种基本形式：双驱冲突、双避冲突、趋避冲突、双重趋避式冲突。双趋冲突（E错）是两个目标具有相同的吸引力，引起同样强度的动机，但由于受条件等因素的限制，无法同时实现，二者必择其一，即所谓“鱼和熊掌不可兼得”。双避冲突（D错）指一个人同时受到两种事物的威胁，产生同等强度的逃避动机，但迫于情势，必须接受其中一个，才能避开另一个，处于左右为难，进退维谷的紧张状态。所谓“前有狼，后有虎”的矛盾冲突。趋避冲突（B对）指一个人对同一事物同时产生两种动机，即向往得到它，同时又想拒绝和避开它。题中患者既想见又不想见的矛盾心理属于趋避冲突。双重趋避式冲突（A错）指多个目标，每个目标对自己都有利也都有弊，反复权衡拿不定主意所产生的冲突。